下列关于锁骨下静脉的叙述，错误的是
A. 与颈内静脉会合成头臂静脉
B. 与颈外静脉构成静脉角
C. 是腋静脉的延续
D. 有锁骨下动脉与其伴行
E. 上肢的深静脉均汇入锁骨下静脉

正确答案：B。与颈外静脉构成静脉角

解析：锁骨下静脉与颈内静脉会合成头臂静脉（A对）。锁骨下静脉与颈内静脉（B错，为本题正确答案）构成静脉角。是腋静脉的延续（C对）。伴行于锁骨下动脉（D对）。上肢的深静脉均汇入锁骨下静脉（E对）。